体液是指
A. 细胞外液
B. 细胞内液
C. 细胞内液和细胞外液
D. 血浆
E. 组织液

正确答案：C。细胞内液和细胞外液